男，45岁，有高血压史。因阵发性心悸2天来诊，体检：血压120/70mmHg，心率180次/分，律齐，心音正常，无杂音。1分钟后心率降至80次/分，律齐。30秒后又恢复至180次/分。最可能的诊断为
A. 窦性心动过速
B. 阵发性心房颤动
C. 阵发性室上性心动过速
D. 阵发性心房扑动
E. 第三度房室传导阻滞

正确答案：C。阵发性室上性心动过速

解析：患者中年男性，阵发性心悸，发作呈现突然起始与终止（阵发性室上性心动过速最典型的特点），发作时心率180次/分（阵发性室上性心动过速心率常为150～250次/分），心律规则，心音正常，故患者最可能的诊断为阵发性室上性心动过速（C对）。窦性心动过速（P182）（A错）通常逐渐开始和终止，频率大多在100～150次/分之间。阵发性心房颤动（B错）是指房颤持续时间≤7天（常≤48小时），能自行终止。心室率通常在100～160次/分之间，心律绝对不齐是心房颤动的主要体征之一。阵发性心房扑动（P187）（D错）的心房率常为250～300次/分，心室率规则或不规则，发作时少见心室率突然升高或降低现象。第三度房室传导阻滞（P203）（E错）的特点为：①心房和心室活动各自独立、互不相关；②心房率快于心室率；③心室起搏点通常在阻滞部位稍下方。且三度房室阻滞的第一心音轻度经常变化，第二心音可呈正常或反常分裂。